女性，22岁，因右下智齿低位埋伏阻生，要求拔除。为减少出血，保持术野清晰，常在麻约中加入肾上腺素，拔除该牙应麻醉的神经是同侧的下牙槽神经+颊神经+舌神经，注射麻药后出现左眼睑闭合不全，可能的原因是
A. 麻醉下牙槽神经
B. 麻醉了嚼肌神经
C. 麻醉了颊神经
D. 麻醉了面神经
E. 口服激素

正确答案：D。麻醉了面神经

解析：本题考查局麻并发症-暂时性面瘫。面神经在腮腺内的分支可分为颞支、颧支、颊支、下颌缘支、颈支，当颧支损伤或被麻醉时会出现眼睑闭合不全（D对）；麻醉下牙槽神经可出现同侧下唇口角麻木、肿胀（A错）。麻醉咀嚼肌神经会造成张口受限（B错）；麻醉了颊神经可鼻唇沟消失、鼓腮无力（C错）。长期大量应用激素，可引起肾上腺皮质功能亢进症、肌萎缩、骨质疏松、诱发精神症状及延缓伤口愈合等（E错）。